对妇女绝经后骨质疏松合并更年期症状者宣选用
A. 钙制剂+维生素D+双膦酸盐
B. 维生素D
C. 钙制剂+维生素+雌激素
D. 特拉唑嗪
E. 降钙素

正确答案：C。钙制剂+维生素+雌激素

解析：本题考查骨质疏松症的药物治疗。对妇女绝经后骨质疏松合并更年期症状者宣选用钙制剂+维生素+雌激素（C对）。钙制剂+维生素D+双膦酸盐（A错）用于治疗老年性骨质疏松症。维生素D（B错）用于治疗抗癫痫药所致OP。特拉唑嗪（D错）用于治疗轻度或中度前列腺增生引起的排尿困难和轻度或中度高血压。降钙素（E错）用来缓解骨痛。